肠内营养并发症与输入速度及溶液浓度有关的是
A. 误吸
B. 腹胀、腹泻
C. 肠炎
D. 肠道细菌移位
E. 胆囊结石

正确答案：B。腹胀、腹泻

解析：肠内营养并发症主要包括误吸、腹胀腹泻，其中与输入速度及溶液浓度有关的是腹胀、腹泻（B对）。肠内营养液为高渗，若输入过快或浓度过高，高渗食物在小肠内从肠壁内吸收大量体液入肠，引发腹胀、腹泻。误吸（A错）多见于昏迷、呃逆患者，或由于鼻胃/肠管或造瘘管固定不当脱落而引发，与输入速度与浓度无关。肠炎（C错）可由营养液污染引发，与营养液输入速度及浓度无关。肠道细菌移位（D错）、胆囊结石（E错）是肠外营养的并发症，肠内营养一般不出现。肠道细菌移位是由于肠道内有益菌群落缺乏营养而死亡，有害群落大量繁殖引起的。胆囊结石是由于长期禁食使胆囊排空障碍，胆汁淤积、浓缩并出现胆色素沉淀而形成。